细辛中的毒性成分是
A. 白桦酸
B. 大黄酸
C. 马兜铃酸
D. 绿原酸
E. 没食子酸

正确答案：C。马兜铃酸

解析：本题考查的是细辛的毒性成分。细辛中的毒性成分是马兜铃酸（C对）。细辛中主要成分及其化学结构：辽细辛的主要化学成分为挥发油、木脂素类和黄酮类等。挥发油约占其含量的3%。《中国药典》以细辛脂素为指标成分进行含量测定，含量不得少于0.050%。同时规定挥发油不得少于2.0%（ml/g）。细辛含有痕量的马兜铃酸Ⅰ，有肝肾毒性。《中国药典》对马兜铃酸Ⅰ进行限量检查，要求其含量不得过0.001%。白桦酸（A错）为酸枣仁的化学成分。酸枣仁中含白化醇和白桦酸，属于羽扇豆烷型五环三萜。大黄酸（B错）为大黄抗菌的有效成分、没食子酸（E错）为大黄止血的有效成分。大黄中的主要蒽醌类成分及其化学结构：从大黄中分离得到蒽醌、二蒽酮、芪、苯丁酮、单宁、萘色酮等不同种类的80多种化合物，大体上可分为蒽醌类、多糖类与鞣质类。其中蒽醌类及其衍生物含量为3%～5%，分为游离型与结合型。《中国药典》以总蒽醌和游离蒽醌为指标成分，采用高效液相色谱法测定药材和饮片中芦荟大黄素、大黄酸、大黄素、大黄酚和大黄素甲醚等总蒽醌的含量，要求药材总蒽醌不得少于1.5%，游离蒽醌不得少于0.20%。绿原酸（D错）为金银花的化学成分。金银花中主要含有木犀草苷和有机酸类化合物。《中国药典》规定，金银花含木犀草苷不得少于0.050%，含绿原酸不得少于1.5%，含酚酸类的总量不得少于3.8%。